业务员纪某因身体不适去医院就诊，被初步诊断为疑似传染性非典型肺炎，并被实施单独隔离治疗。2天后，纪某厌倦了被隔治疗的状态，要求出院；医院反复劝说，不予批准。纪某于当晚溜出医院并回家；医院发现纪某失踪后立即向有关部门报告。家人得知纪某情况后动员其尽快返回医院接受隔离治疗，被纪某拒绝。纪某作为患者未履行的主要道德义务是
A. 交纳医疗费用
B. 尊重医生劳动
C. 支持医学发展
D. 配合医师诊治
E. 报告所在单位

正确答案：D。配合医师诊治

解析：患者纪某因被初步诊断为疑似传染性非典型肺炎，被实施单独隔离治疗，在隔离期间纪某擅自脱离并拒绝隔离治疗，其主要未履行作为患者应配合医师诊治（D对）的道德义务，交纳医疗费用（A错）、尊重医生劳动（B错）、支持医学发展（C错）均为患者应履行的义务但均不符合题干，报告所在单位（E错）亦不符合题干所问。